电击伤主要损害
A. 心脏
B. 肺
C. 肝
D. 肾
E. 皮肤

正确答案：A。心脏

解析：电流通过人体可引起全身和局部损伤，其严重程度取决于电流强度和性质、电压、接触时间、接触部位的电阻等，一般而言，交流电比直流电危险，低频率较高频率危险，电流越强，接触时间越长，越危险，50～0Hz的110～220V的交流电，对心脏有很强的损害作用，特别是接触部位电阻低，进入体内的电流强度大时，往往立即致死。故电击伤主要损害的器官是心脏（A对），其次为脑。